苓甘五味姜辛汤和半夏白术天麻汤组成中共有的药物为
A. 茯苓、甘草
B. 干姜、细辛
C. 五味子、橘红
D. 天麻、白术
E. 半夏、细辛

正确答案：A。茯苓、甘草

解析：苓甘五味姜辛汤组成，茯苓 甘草 干姜 细辛 五味子。半夏白术天麻汤组成，半夏 天麻 茯苓 橘红 白术 甘草。苓甘五味姜辛汤和半夏白术天麻汤组成中共有的药物为茯苓、甘草（A对）。